颈总动脉
A. 平甲状软骨上缘分为颈内、外动脉
B. 起于主动脉弓
C. 分叉处稍膨大形成颈动脉小球
D. 与迷走神经及颈外静脉伴行
E. 无

正确答案：A。平甲状软骨上缘分为颈内、外动脉

解析：颈总动脉在平甲状软骨上缘分为颈内、外动脉（A对）。左颈总动脉起自主动脉弓（B错），右颈总动脉起自头臂干。